根据《易制毒化学品管理条例》，下列叙述正确的有
A. 第一类易制毒化学品是可以用于制毒的辅助原料
B. 第一类易制毒化学品是可以用于制毒的主要原料
C. 第二类易制毒化学品是可以用于制毒的化学配剂
D. 第三类易制毒化学品是可以用于制毒的主要原料
E. 第三类易制毒化学品是可以用于制毒的化学配剂

正确答案：B、C、E。第一类易制毒化学品是可以用于制毒的主要原料；第二类易制毒化学品是可以用于制毒的化学配剂；第三类易制毒化学品是可以用于制毒的化学配剂

解析：本题考查易制毒化学品品种与分类。根据《易制毒化学品管理条例》，下列叙述正确的有第一类易制毒化学品是可以用于制毒的主要原料（B对）；第二类易制毒化学品是可以用于制毒的化学配剂（C对）；第三类易制毒化学品是可以用于制毒的化学配剂（E对）。易制毒化学品品种与分类：易制毒化学品分为三类。第一类是可以用于制毒的主要原料，第二类、第三类是可以用于制毒的化学配剂。药品类易制毒化学品属于第一类易制毒化学品。